前列环素产生的主要部位是
A. 内皮细胞
B. 红细胞
C. 肥大细胞
D. 巨噬细胞
E. 血小板

正确答案：A。内皮细胞

解析：休克时内皮细胞（A对）的损伤，既可使PGI2 生成释放减少，也可因胶原纤维暴露，使血小板（E错）激活、黏附、聚集，生成和释放TXA 2增多。各种休克时红细胞（B错）破坏释放的ADP等可启动血小板的释放反应，促进凝血过程。肥大细胞（C错）在长期缺血缺氧、酸中毒的刺激下可释放组胺增多。